法洛氏四联症最早且主要的表现是
A. 蹲踞
B. 青紫
C. 突然晕厥
D. 杵状指（趾）
E. 活动耐力下降

正确答案：B。青紫

解析：法洛氏四联症最早且主要的表现是青紫（B对），其出现的早晚与肺动脉口狭窄程度有关，一般在出生3个月后出现。蹲踞（A错）、活动耐力下降（E错）表现出现的比青紫晚，一般在小儿会行走前后，即1岁左右。突然晕厥（C错）属于阵发性缺氧症状发作，多在生后6个月开始出现。杵状指（趾）（D错）一般是由于患儿长期缺氧、发绀持续6个月（即9个月左右小儿）以上才会出现。